暑热感冒颗粒的功效
A. 祛暑利湿，补气生津
B. 祛暑除湿，和胃消食
C. 祛暑解表，清热生津
D. 解表化湿，理气和中
E. 清热解毒，利湿化浊

正确答案：C。祛暑解表，清热生津

解析：本题考查的是暑热感冒颗粒的功能。暑热感冒颗粒的功效祛暑解表，清热生津（C对）。暑热感冒颗粒：【功能】祛暑解表，清热，生津。清暑益气丸：【功能】祛暑利湿，补气生津（A错）。六合定中丸：【功能】祛暑除湿，和中消食（B错）。藿香正气水：【功能】解表化湿，理气和中（D错）。功能为清热解毒，利湿化浊（E错）的中成药，2022年考试指南未明确说明。